唾液腺恶性肿瘤中最常见的是
A. 沃辛瘤
B. 多形性腺瘤
C. 腺泡细胞癌
D. 黏液表皮样癌
E. 以上说法均正确

正确答案：D。黏液表皮样癌

解析：黏液表皮样癌是唾液腺恶性肿瘤中最常见者。掌握“黏液表皮样癌”知识点。